流行病学统计女性发病多于男性的是
A. 慢性盘状红斑狼疮
B. 慢性唇炎
C. 牙龈癌
D. 沟纹舌
E. 龋病

正确答案：A。慢性盘状红斑狼疮

解析：本题考查盘状红斑狼疮的流行病学。盘状红斑狼疮是结缔组织病的典型代表，调查发现，DLE（慢性盘状红斑狼疮）（A对）的发病率约为0.4%～0.5％，女性患者约为男性的2倍。牙龈癌（C错）的发病情况男性多于女性。慢性唇炎（B错）包括慢性脱屑性唇炎（多见于30岁以前的女性）、慢性糜烂性唇炎，总体并无明显的性别差异。沟纹舌（D错）、龋病（E错）发病无性别差异。